日本药典的缩写是
A. BP
B. ChP
C. JP
D. pH.Eur.
E. USP

正确答案：C。JP

解析：本题考查药典。日本药典的名称是《日本药局方》，缩写为JP（C对）；BP（A错）是英国药典的缩写；ChP（B错）是中国药典的缩写；pH.Eur.（D错）是欧洲药典的缩写；USP（E错）是美国药典的缩写。